位于上颌或下颌中线区的囊状低密度影像，与牙无关为
A. 含牙囊肿
B. 残余囊肿
C. 正中囊肿
D. 球上颌囊肿
E. 鼻腭管囊肿

正确答案：C。正中囊肿

解析：本题考查正中囊肿。位于上颌或下颌中线区的囊状低密度影像，与牙无关为正中囊肿（C对）。正中囊肿：位于上颌或下颌中线区的囊状低密度影，与牙无关。